某男，45岁，患风湿痛3年，近日又患肠痈腹痛，治当清热解毒，活血止痛，祛风通络，宜选用的药是
A. 大血藤
B. 野菊花
C. 密蒙花
D. 金荞麦
E. 土茯苓

正确答案：A。大血藤

解析：本题考查大血藤的功效。某男，45岁，患风湿痛3年，近日又患肠痈腹痛，治当清热解毒，活血止痛，祛风通络，宜选用的药是大血藤（A对）。大血藤【功效】清热解毒，活血止痛，祛风通络。野菊花（B错）【功效】清热解毒，疏风平肝。密蒙花（C错）【功效】清热养肝，明目退翳。金荞麦（D错）【功效】清热解毒，祛痰排脓，散瘀止痛，健脾除湿。土茯苓（E错）【功效】解毒，利湿，通利关节。